小儿生理性免疫功能低下的时期最主要是
A. 学龄前期
B. 围生期
C. 学龄期
D. 青春期
E. 婴幼儿期

正确答案：E。婴幼儿期

解析：婴幼儿期是自出生至满3周岁之前，此期容易发生消化系统紊乱，小儿生理性免疫功能低下（E对），易发生各种感染。围生期是指妊娠满28周至出生后7天，此期为儿童死亡率最高的时期（B错）。学龄前期（A错）是自3周岁至6~7岁入小学前，免疫系统相对婴幼儿期较为成熟。学龄期（C错）是自入小学始至青春期前，除生殖系统，其余各器官系统外形均已接近成人。青春期（D错）一般为10~20岁，此期儿童体格生长发育再次加速，出现第二次高峰，同时生殖系统的发育也加速并渐趋完善。